痰培养结果为铜绿假单胞菌，宜选用的抗菌药物是
A. 哌拉西林他唑巴坦
B. 青霉素G
C. 苯唑西林
D. 苄星青霉素
E. 阿莫西林

正确答案：A。哌拉西林他唑巴坦

解析：本题考查抗菌药物。痰培养结果为铜绿假单胞菌，宜选用的抗菌药物是哌拉西林他唑巴坦（A对）。青霉素G（B错）适用于溶血性链球菌、肺炎链球菌、对青霉素敏感（不产青霉素酶）金葡菌等革兰阳性球菌所致的感染以及破伤风、气性坏疽、流行性脑脊髓膜炎、鼠咬热、梅毒、淋病。苯唑西林（C错）用于治疗甲氧西林敏感金葡菌引起的肺炎。苄星青霉素（D错）用于预防风湿热、治疗各期梅毒，也可用于控制链球菌感染的流行。阿莫西林（E错）用于敏感菌所致的泌尿生殖道感染、上呼吸道感染、皮肤软组织感染、下呼吸道感染、胆道感染、伤寒等。